治疗中风痰壅，口眼歪斜，破伤风之证者，应选用的药物是
A. 羚羊角
B. 天南星
C. 天麻
D. 地龙
E. 白芥子

正确答案：B。天南星

解析：天南星的功效为燥湿化痰，祛风止痉，散结消肿。天南星苦泄辛散温行，入肝经，可通行经络，尤善祛风痰，止痉搐。可用于治疗中风痰壅口眼歪斜破伤风之证者（B对）。羚羊角的功效为平肝息风，清肝明目，清热解毒。治疗肝风内动，惊痫抽搐，妊娠子痫，高热痉厥，癫痫发狂；肝阳上亢，头痛眩晕；肝火上炎，目赤翳障；温热病壮热神昏，温毒发斑；痈肿疮毒（A错）。天麻的功效为息风止痉，平抑肝阳，祛风通络。治疗小儿惊风，癫痫抽搐，破伤风；肝阳上亢，头痛眩晕；手足不遂，肢体麻木，风湿痹痛（C错）。地龙的功效为清热定惊，通络，平喘，利尿。治疗高热神昏，惊痫抽搐，癫狂；关节痹痛，肢体麻木，半身不遂；肺热喘咳；湿热水肿，小便不利或尿闭不通（D错）。白芥子的功效为温肺豁痰，利气散结，通络止痛。治疗寒痰咳喘，悬饮胸胁胀痛；痰滞经络，关节麻木疼痛，痰湿流注，阴疽肿毒（E错）。